尖锐器械在使用时做法错误的是
A. 传递探针、镊子时，避免锐端朝向接受者
B. 用后的车针应立即从手机上取下
C. 尖锐器械护士要手对手式传递给医师
D. 用后尖锐物品应弃于耐刺的硬壳锐器盒内
E. 仍需继续使用的车针头应该保持向下向内状态

正确答案：C。尖锐器械护士要手对手式传递给医师

解析：尖锐器械使用的原则是小心防范，避免伤害。如传递探针、镊子时，避免锐端朝向接受者；用后的车针应立即从手机上取下，仍需继续使用的车针头应该保持向下向内状态；尖锐器械不可以由护士“手对手式传递”给医师，而是由护士准备好后放置在综合治疗台支架桌上，由医师自己取用；用后的针头及尖锐物品应弃于耐刺的硬壳锐器盒内，且该容器应放置在治疗区附近。掌握“患者、医务人员及环境的防护”知识点。